男，26岁，上肢血压180～200/100～110mmHg，下肢血压140/80mmHg，体检：肩胛间区可闻及血管杂音，伴震颤，尿17-羟类固醇正常，尿苦杏仁酸正常。其高血压原因应考虑为继发于
A. 皮质醇增多症
B. 主动脉缩窄
C. 嗜铬细胞瘤
D. 原发性醛固酮增多症
E. 单侧肾动脉狭窄

正确答案：B。主动脉缩窄

解析：青年男性，上臂血压高，下肢血压不高，体检肩胛间区闻及血管杂音伴震颤，尿酮，17-羟类固醇正常，尿苦杏仁酸正常，其高血压原因应考虑为继发于主动脉缩窄（B对）。皮质醇增多症（A错）80%患者有高血压，同时有向心性肥胖、满月脸、水牛背、皮肤紫纹、毛发增多、血糖增高等表现，但其24小时尿中17-羟和17-酮类固醇增多，与该患者表现不符，故应排除。嗜铬细胞瘤（C错）典型的发作表现为阵发性血压升高伴心动过速、头痛、出汗、面色苍白，在发作期间可测定血或尿儿茶酚胺显著增高，而该患者尿酮正常，与其表现不符，故应排除。原发性醛固酮增多症（D错）临床上以长期高血压伴低血钾为特征，可有肌无力、周期性瘫痪、烦渴、多尿等症状，而该患者未有肌无力、周期性瘫痪等低钾的表现，与其表现不符，故应排除。单侧肾动脉狭窄（E错）表现为进展迅速或突然加重高血压，体检时可在上腹部或背部肋脊角处可闻及血管杂音，但其上下肢血压并不会出现较大差异，与其表现不符，故应排除。